心脏充盈受限最常见于下列哪种心肌病
A. 扩张性心肌病
B. 肥厚性心肌病
C. 限制性心肌病
D. 克山病
E. 见于所有心肌病

正确答案：C。限制性心肌病

解析：限制性心肌病的主要病理变化是心内膜心肌纤维化导致全心腔狭窄，故是以心室充盈受限为最主要特征的心肌病；而肥厚性心肌病的主要病理变化是非对称性室间隔肥厚，故是以心肌肥厚为特征的心肌病，严重的心肌肥厚可引起心室腔狭窄（以左室尤其显著），从而导致左心室充盈受阻。由此可见，相较于肥厚性心肌病，心脏充盈受限更常见于限制性心肌病（C对）。扩张性心肌病（A错）以左心室、右心室或双心室腔扩大，收缩功能障碍等为特征，不会引起心脏充盈受限。克山病（D错）的主要病理变化是心肌严重的变性、坏死和瘢痕形成，导致心脏不同程度增大，因此也不会引起心脏充盈受限。